根据美国哈佛医学院提出的“脑死亡”概念，不能确诊“脑死亡”的条件是
A. 自主运动和自主呼吸消失
B. 对外部刺激和内部需求毫无知觉和反应
C. 体温低于32.2℃或服用中枢抑制药物者
D. 脑电波平直或等电位
E. 诱导反射消失

正确答案：C。体温低于32.2℃或服用中枢抑制药物者

解析：“脑死亡”标准为对周遭的环境完全没有反应（B对）、完全失去反射能力和肌肉紧张度（E对）、缺乏自主性的呼吸作用（A对）、如果不用人工辅助器，动脉血压会剧降、在没有任何技术问题的情况下，即使用人为的方式刺激脑部，病人的脑电图仍然呈现绝对的直线反应（D对）。体温低于32.2℃或服用中枢抑制药物者不属于“脑死亡”的确诊条件（C错，为本题正确答案）。